氯丙嗪引起的迟发性运动障碍的精神分裂症患者宜选用的药物是
A. 氟哌啶醇
B. 氟哌利多
C. 三氟哌多
D. 氯普噻吨
E. 氯氮平

正确答案：E。氯氮平